低渗性脱水时机体表现为
A. 细胞内液降低，细胞外液明显降低
B. 细胞内液明显降低，细胞外液降低
C. 细胞内液明显降低，细胞外液明显降低
D. 细胞内液升高，细胞外液明显降低
E. 细胞内液明显降低，细胞外液正常

正确答案：D。细胞内液升高，细胞外液明显降低

解析：低渗性脱水时细胞外液渗透压降低，细胞外液的水分向渗透压相对高的细胞内液转移，使细胞内液升高，细胞外液进一步降低（D对）。而高渗性脱水时，由于细胞外液高渗，可使渗透压相对较低的细胞内液向细胞外转移，使细胞内液与细胞外液均降低（ABC错）。